有关肺动脉干的说法，错误的是
A. 起于右心室
B. 是一粗短的动脉干
C. 内流着动脉血液
D. 经升主动脉前方行向左后上方
E. 在主动脉弓下分为左、右肺动脉

正确答案：C。内流着动脉血液

解析：肺动脉干起自右心室（A对），系一粗短的动脉干（B对），经升主动脉前方行向左后上方（D对），至主动脉弓的下方分为左、右肺动脉（E对）。肺动脉干及其分支内流着静脉血液（C错，为本题正确答案）。